胆汁酸按其来源亦可分为
A. 初级胆汁酸和次级胆汁酸
B. 游离胆汁酸和结合胆汁酸
C. 初级胆汁酸和终级胆汁酸
D. 亲水胆汁酸和疏水胆汁酸
E. 分散胆汁酸和结合胆汁酸

正确答案：A。初级胆汁酸和次级胆汁酸

解析：胆汁酸按其来源亦可分为初级胆汁酸和次级胆汁酸两类。掌握“胆汁酸代谢”知识点。